通过抑制H⁺泵而减少胃酸分泌的药物是
A. 奥美拉唑
B. 米索前列醇
C. 西咪替丁
D. 哌仑西平
E. 氢氧化铝

正确答案：A。奥美拉唑

解析：本题考查奥美拉唑。奥美拉唑（A对）可通过抑制H⁺泵而减少胃酸分泌。质子泵抑制剂（H⁺泵抑制剂）通过高效快速抑制胃酸分泌和清除幽门螺旋杆菌达到快速治愈溃疡。其作用机制是与H⁺，K⁺-ATP酶结合形成复合物，抑制H⁺，K⁺-ATP酶的活性，从而抑制胃酸生成的终末环节。主要药物有奥美拉唑、泮托拉唑、雷贝拉唑等。米索前列醇（B错）是一种合成前列素E₁类似物，它通常用于预防和治疗由非甾体抗炎药引起的十二指肠损伤；西咪替丁（C错）为组胺H₂受体阻断剂，其作用机制是阻断组胺H₂受体，可逆性竞争壁细胞基底膜上的H₂受体，从而抑制胃酸分泌；哌仑西平（D错）是一种具有选择性的抗胆碱能药物，对胃壁细胞的毒蕈碱受体有高度亲和力，从而抑制胃酸分泌；氢氧化铝（E错）为抗酸剂，可直接中和胃酸，但不能抑制胃酸分泌。